哌唑嗪按常用剂量开始用药，常致低血压，属于
A. 副作用
B. 毒性反应
C. 首剂效应
D. 药物本身作用
E. 变态反应

正确答案：C。首剂效应

解析：本题考查首剂效应。哌唑嗪按常用剂量开始用药，常致低血压，属于首剂效应（C对）。高血压患者按照常规剂量服用哌唑嗪片，开始治疗时产生眩晕、心悸、体位性低血压。这种对药物尚未适应而引起的不可耐受的反应称为首剂效应。副作用（A错）是指在药物按正常用法用量使用时，出现的与治疗目的无关的不适反应。毒性反应（B错）是指在剂量过大或药物在体内蓄积过多时发生的危害性反应。变态反应（E错）是指机体受药物刺激所发生的异常免疫反应，引起机体生理功能障碍或组织损伤，也称过敏反应。